研究医学心理学，根据研究涉及的手段分类，其中不包括的是
A. 观察法
B. 调查法
C. 测验法
D. 个案法
E. 纵向法

正确答案：E。纵向法

解析：本题考查医学心理学研究方法及其应用。医学心理学是一门临床应用学科，其研究方法也有许多临床特点。按研究涉及的手段可以分为观察法（A对）、调查法（B对）、测验法（C对）、个案法（D对）与实验法。纵向法（E错，为本题正确答案）属于根据研究涉及的时间分类。